下述哪个不参与构成大脑动脉环
A. 大脑前动脉起始段
B. 前交通动脉
C. 大脑中动脉起始段
D. 后交通动脉
E. 大脑后动脉

正确答案：C。大脑中动脉起始段

解析：大脑动脉环由两侧大脑前动脉起始段（A错）、两侧颈内动脉末段、两侧大脑后动脉（E错）借前交通动脉（B错）、后交通动脉（D错）共同构成。大脑中动脉起始段（C对）不参与构成大脑动脉环。